数目最多，力量最强大的纤维，起悬吊牙齿的作用的是
A. 牙槽嵴组
B. 水平组
C. 斜行组
D. 根间组
E. 根尖组

正确答案：C。斜行组

解析：斜行组：是牙周膜中数量最多、力量最强的一组纤维。除牙颈部和根尖区外，纤维方向向根方倾斜约45°角，埋入牙槽骨的一端近牙颈部，将牙悬吊在牙槽窝内。这种结构可将牙承受的咀嚼压力转变为牵引力，均匀地分散到牙槽骨上。掌握“牙周膜”知识点。